治疗子肿气滞证，应首选
A. 丹栀逍遥散
B. 通窍活血汤
C. 乌药汤
D. 天仙藤散
E. 龙胆泻肝丸

正确答案：D。天仙藤散

解析：妊娠中晚期，孕妇出现肢体面目肿胀者称“子肿”，亦称“妊娠肿胀”。子肿气滞湿阻证的病机是孕后胎体渐长，有碍气机升降两因相感，气滞痰湿，浊阴下滞，溢于肌肤。治应理气行滞，除湿消肿，宜选用疏气活血，能解血中之风气之天仙藤散（D对）。丹栀逍遥散（A错）主治肝郁血虚内热证；乌药汤（C错）主治经行腹痛；通窍活血汤（B错）主治经行头痛血瘀证；龙胆泻肝丸（E错）主治肝经实火上炎及肝经湿热下注。